肺气不得宣散，上逆喉间，气道窒塞，呼吸急促，称为
A. 喘证
B. 哮证
C. 上气
D. 短气
E. 少气

正确答案：C。上气

解析：题目中的五个选项均属于病态呼吸。上气是指肺气不得宣散，上逆喉间，气道窒塞，呼吸急促的表现（C对）。喘证即气喘，指呼吸困难、急迫，张口抬肩，甚至鼻翼煽动，难以平卧（A错）。哮证指呼吸急促似喘，喉间有哮鸣音的症状（B错）。短气是指呼吸气急而短促，气短不足以息，数而不相接续的症状（D错）。少气又称气微。指呼吸微弱而声低，气少不足以息，言语无力的症状（E错）。